在一项病例对照研究中，某研究因素与疾病之间关联的OR的95%可信区间为0.35～0.75，该因素可能为
A. 混杂因素
B. 危险因素
C. 保护因素
D. 无关因素
E. 匹配因素

正确答案：C。保护因素

解析：本题考查比值比的意义。比值比（OR）指暴露者疾病的危险性是非暴露者的多少倍。OR＞1，说明暴露与疾病呈正关联，即暴露可增加疾病的危险性，暴露因素是疾病的危险因素；OR＜1，说明暴露与疾病呈负关联，即暴露可降低疾病的危险性，暴露因素是保护因素（C对ABDE错）；OR＝1，表明暴露因素与疾病之间无统计学联系。